易出现义齿的翘动等不稳定现象的可摘局部义齿的类型
A. 牙与黏膜混合支持式义齿
B. 胶连式义齿
C. 牙支持式义齿
D. 金属铸造支架式义齿
E. 黏膜支持式义齿

正确答案：A。牙与黏膜混合支持式义齿

解析：牙与黏膜混合支持式义齿：义齿承受的咬合力一部分通过基牙上的（牙合）支托传递至基牙，另一部分通过义齿基托传递至承托区黏膜和牙槽骨，由基牙和黏膜（牙槽骨）共同承担（牙合）力。适用于缺失牙数目多，缺隙长，尤其是有游离端缺失者。混合支持式义齿易出现义齿的翘动等不稳定现象，末端基牙易受扭力。掌握“局部义齿类型，肯氏分类及模型观测”知识点。